与相对危险度有关的是
A. 暴露组与非暴露组的疾病发病率
B. 病例组人群的暴露率
C. 暴露组的疾病死亡率
D. 人群的平均暴露水平
E. 人群中暴露的比例

正确答案：A。暴露组与非暴露组的疾病发病率

解析：本题考查相对危险度的相关内容。相对危险度包括危险比或率比，是暴露组发病率或死亡率与非暴露组发病率或死亡率之比（A对BCDE错）。当它有统计学意义时，RR＝1，说明暴露因素与疾病之间无关联；RR＞1，说明暴露因素是疾病的危险因素（正相关）；RR＜1，说明暴露因素是疾病的保护因素（负相关）。